男性，40岁。诉左下颌后牙有洞1年求补。无明显自觉症状，患者1周前刚完成肿瘤放疗疗程。口腔检查：左下6残冠，已穿髓底，无法牙体修复，建议拔除。拔牙时机应选择在
A. 半年后
B. 1年后
C. 2年后
D. 3个月后
E. 3年后

正确答案：E。3年后

解析：本题考查恶性肿瘤的拔牙时机。颌骨放射性骨损伤主要是射线对骨细胞的直接损伤，颌骨有发生无菌性坏死的可能，在此基础上，如口腔卫生不佳、牙源性感染以及损伤或施行拔牙手术等，均可导致继发感染，形成放射性颌骨骨髓炎（放射性颌骨坏死）。一般认为，在放疗后3～5年（E对）内不应拔牙,不管是半年后（A错），1年后（B错）,2年后（C错）,3个月后（D错）间隔时间都太短,发生放射性骨坏死可能性很大，因此建议至少在放疗3年后进行拔牙，这样发生放射性骨坏死可能性小，有利于患者健康。